胸腺依赖性抗原（TD-Ag）又称
A. TI-Ag
B. B细胞依赖抗原
C. T细胞依赖抗原
D. 外源性超抗原
E. 内源性超抗原

正确答案：C。T细胞依赖抗原

解析：胸腺依赖性抗原（TD-Ag），又称T细胞依赖抗原。掌握“抗原基本概念、分类、超抗原及佐剂”知识点。